给一病人输血20ml，病人感觉头痛、恶心、寒战、呼吸困难、心前区压迫感，可能发生
A. 溶血反应
B. 细菌污染反应
C. 过敏反应
D. 免疫反应
E. 发热反应

正确答案：A。溶血反应

解析：患者输血20mL后感觉头痛、恶心、寒战、呼吸困难、心前区压迫感，可能发生溶血反应（A对）。溶血反应典型表现为病人输入十几毫升血型不合的血后，立即出现寒战、高热、呼吸困难等症状。细菌污染反应（B错）中，若细菌毒力小则仅出现发热反应，若细菌毒力大则可立即出现内毒素性休克和DIC，但发生率不高。过敏反应（C错）多发生在输血数分钟后，表现为皮肤瘙痒或荨麻疹。免疫反应（D错）一般出现在大量输血以后。发热反应（E错）多发生于输血开始后15分钟-2小时内，主要表现为畏寒、高热。